宜于餐后或睡前顿服的组胺H₂受体阻断剂是
A. 奥美拉唑
B. 地塞米松
C. 枸橼酸铋钾
D. 多潘立酮
E. 法莫替丁

正确答案：E。法莫替丁

解析：本题考查药物的使用。法莫替丁（E对）属于组胺H₂受体阻断剂，在餐后或睡前服用效果比较好，因为餐后胃排空延迟，可以有更多的缓冲作用。奥美拉唑（A错）属于质子泵抑制剂，空腹服药吸收快，在晨起或餐前30min内服用比较好。地塞米松（B错）属于肾上腺糖皮质激素，用药时间因给药方式不同而不同。枸橼酸铋钾（C错）属于胃黏膜保护剂，宜在餐前1h或睡前服用。多潘立酮（D错）属于促动力药，宜在餐前15～20min服用，餐后吸收延迟。